糖异生途径中的关键酶是
A. 果糖二磷酸酶-1
B. 6-磷酸果糖激酶-1
C. HMG-CoA还原酶
D. 磷酸化酶
E. HMG-CoA合成酶

正确答案：A。果糖二磷酸酶-1

解析：糖异生途径中的关键酶是果糖二磷酸酶-1（A对）。6-磷酸果糖激酶（B错）是糖酵解途径中的关键酶。磷酸化酶（D对）是指将供体的磷酸基团转移到受体上的一类酶，其中糖原磷酸化酶是糖原分解过程中的关键酶。HMG-CoA还原酶（C错）是胆固醇合成的关键酶；HMG-CoA合成酶（E错）在酮体及胆固醇的合成中均有用到，但它并不是关键酶。